女，50岁，因患短肠综合症，予全胃肠外营养（TPN）治疗。应用一周时病人出现昏迷，但尿内无酮体。病人既往曾有空腹血糖高（11mmol/L）。此病的发病机制是由于
A. 内源性胰岛素分泌不足
B. 等渗性脱水
C. 输液导管细菌滋生
D. 肝功能损害
E. 肾功能损害

正确答案：A。内源性胰岛素分泌不足

解析：该患者既往曾有空腹血糖高（11mmol／L），可诊断为糖尿病。该患者突然昏迷、尿酮阴性，应考虑高渗高血糖综合征导致的昏迷，即高渗性非酮性昏迷。其发病机制是：糖尿病患者内源性胰岛素分泌不足，不能适应肠外营养的相对高渗溶液，导致血糖过高（A对）而引发组织高渗性脱水和进行性意识障碍。